某医师常选用木香配砂仁治湿滞、食积之脘腹胀痛，此因二药配伍后除能化湿、理气外，又能
A. 消食止痛
B. 健脾止痛
C. 温阳止痛
D. 调中止痛
E. 制酸止痛

正确答案：D。调中止痛

解析：本题考查的是砂仁的配伍。某医师常选用木香配砂仁治湿滞、食积之脘腹胀痛，此因二药配伍后除能化湿、理气外，又能调中止痛（D对）。砂仁：【配伍】砂仁配木香：砂仁性温，功能化湿行气温中；木香性温，功能理气调中止痛。两药相配，化湿、理气、调中止痛力胜，凡湿滞、食积，或夹寒所致的脘腹胀痛皆可投用。兼脾虚者，又当配伍健脾之品。